口腔颌面部恶性黑色素瘤临床特点中，错误的一项是
A. 肿瘤生长迅速，常向四周扩散
B. 常发生广泛转移
C. 诊断主要根据色素表现及临床症状，不宜活检
D. 口腔内恶性黑色素瘤多发生于牙龈、腭部及颊部的黏膜
E. 对放疗高度敏感，故治疗以放疗为主

正确答案：E。对放疗高度敏感，故治疗以放疗为主

解析：本题考查恶性黑色素瘤的临床特点。口腔颌面部恶性黑色素瘤临床特点中错误的是对放疗高度敏感，故治疗以放疗为主（E错，为本题的正确答案）。恶性黑色素瘤对放射治疗不敏感，应以综合序列治疗为主，原发灶首选冷冻治疗→化疗→颈部选择性或治疗性清扫术→免疫治疗。恶性黑色素瘤较为恶性，多发生于牙龈、腭及颊部的黏膜（D对），生长迅速，常向四周扩散（A对）。恶性肿瘤常发生广泛转移（B对），约70％早期转移至区域性淋巴结；肿瘤可静血流转移至肺、肝、骨、脑等器官，其远处转移率可高达40％。诊断主要根据色素表现及临床症状，不宜进行活组织检查（C对），因活检可促使其加速增长且使肿瘤播散发生远处转移。